下列哪条动脉的分支，不分布到胃
A. 肠系膜上动脉
B. 胃十二指肠动脉
C. 肝固有动脉
D. 胃左动脉
E. 脾动脉

正确答案：A。肠系膜上动脉

解析：肠系膜上动脉（A错，为本题正确答案）发出的分支均不分布到胃。腹腔干的各级分支，包括胃十二指肠动脉（B对）、肝固有动脉（C对）、胃左动脉（D对）、脾动脉（E对）的分支均有分布到胃。